在高疟区成人常服用哪种药物来预防疟疾
A. 氯喹
B. 卡巴胂
C. 磷酸伯氨喹
D. 甲硝唑
E. 吐根碱

正确答案：A。氯喹

解析：氯喹（A对）是目前非耐药疟疾的首选药物，具有高效、耐受性好、不良反应轻的优点，适宜成人使用。卡巴胂（B错）是一种人工合成的五价胂剂，能抑制虫体2巯基酶活性，能直接杀灭阿米巴滋养体。磷酸伯氨喹（C错）用于防治间日疟、三日疟的复发和传播，以及防止恶性疟的传播。甲硝唑（D错）用于治疗肠道和肠外阿米巴病和厌氧菌的治疗。吐根碱（E错）的盐酸盐对溶组织阿米巴滋养体有直接杀灭作用，可用于治疗急性阿米巴病。